子宫圆韧带的描述，错误的是
A. 上端附于子宫后面的两侧
B. 行经腹股沟管
C. 由平滑肌和结缔组织构成
D. 止于阴阜和大阴唇皮下
E. 具有维待子宫前倾的功能

正确答案：A。上端附于子宫后面的两侧

解析：子宫圆韧带上端附于子宫前面（A错为正确答案）的两侧。